与左旋多巴合用，可提高疗效的是
A. 叶酸
B. 苄丝肼
C. 克拉维酸钾
D. 奥美拉唑
E. 维生素C

正确答案：B。苄丝肼

解析：本题考查药物的联合应用。苄丝肼（B对）为芳香氨基酸脱羧酶抑制剂，可抑制外周左旋多巴脱羧转化为多巴胺的过程，与左旋多巴合用时，可提高后者血药浓度，增强左旋多巴的药效。叶酸（A错）是用于治疗巨幼细胞性贫血的药物。阿莫西林可以用于各种球菌、G⁺杆菌及螺旋体所致的各种感染。克拉维酸（C错）是β内酰胺酶不可逆的竞争型抑制剂。奥美拉唑（D错）属于质子泵拮抗剂，与硫酸亚铁同服，影响铁剂的吸收和利用。维生素C（E错）可以促进硫酸亚铁吸收。